患者，男，62岁，4年前出现运动迟缓，诊断为帕金森病。近来症状逐渐加重并伴有轻度认知障碍。宜选用的药物是
A. 普拉克索
B. 司来吉兰
C. 金刚烷胺
D. 恩他卡朋
E. 苄丝肼-左旋多巴

正确答案：E。苄丝肼-左旋多巴

解析：本题考查帕金森病的治疗。晚发型或伴有智能减退的患者，一般首选复方左旋多巴，代表药物苄丝肼-左旋多巴（E对）、卡比多巴-左旋多巴。早发型患者，在不伴有智能减退的情况下，可有如下选择：①非麦角类选择性多巴胺受体激动剂（普拉克索）（A错）。②单胺氧化酶B（MAO-B）抑制剂（司来吉兰）（B错）。③金刚烷胺（C错）。④复方左旋多巴。⑤复方左旋多巴+COMT抑制剂（恩他卡朋）（D错）。对于震颤明显而其它抗帕金森病药物疗效欠佳的情况下，可选用抗胆碱药，如苯海索。